国家对下列场所实行卫生许可证制度，但除外
A. 公共场所本身
B. 新建公共场所的选地和设计
C. 改建公共场所的选地和设计
D. 扩建公共场所的选地和设计
E. 公共场所的从业人员

正确答案：E。公共场所的从业人员